女，40岁，G3P1，孕42周，规律宫缩7小时，宫口开7CM，S+3，LOA，预估胎儿体重3500g，胎心率正常，体温36.7摄氏度，血压140/90mmHg，心率正常，WBC15.6×10⁹/L。入院复测血压150/90mmHg，除了应用抗生素还应进行的处理是
A. 继续观察
B. 静滴缩宫素
C. 静滴硫酸镁
D. 剖宫产
E. 口服降压药

正确答案：A。继续观察

解析：女，40岁，G3P1，经产妇，规律宫缩7小时，宫口开7CM，第一产程活跃期，S+3，LOA，预估胎儿体重3500g，胎心率正常，胎儿正常，头盆相称，产妇有感染，易导致宫缩乏力，且此时宫口未开全，故需缩宫素加快产程。且患者血压增高，但无其他表现，有可能是子痫前期，但需生产后测血压来确诊，因无其他不适表现，血压可继续观察，不需使用硫酸镁。（A对）。头盆不称或胎位异常头盆不称或胎位异常，估计不能经阴道分娩者，才应及时行剖宫产术（D错）。